患者，男，73岁。左下肢内臁疮，面积8cm×5cm，现疮面仍有少许腐肉。外治应首选
A. 红油膏、九一丹
B. 白玉膏、生肌散
C. 金黄膏、九一丹
D. 金黄膏掺桃花散
E. 青黛膏

正确答案：C。金黄膏、九一丹

解析：疮面肉芽始长时，用白玉膏、生肌散外敷（B错）。疮面周围伴湿疮的，改用青黛散（E错）。疮面出血时掺桃花散（D错）。五版教材认为此症应用红油膏和九一丹。以最新教材和大纲为准。